根据《关于加强基本药物质量监督管理的规定》负责基本药物监督性抽验工作的是
A. 国家药品监督管理部门
B. 国家食品药品检定研究所
C. 省级药品监督管理部门
D. 省级药品检验机构
E. 市级药品监督管理部门

正确答案：C。省级药品监督管理部门

解析：本题考察药品监督管理。根据《关于加强基本药物质量监督管理的规定》负责基本药物监督性抽验工作的是省级药品监督管理部门（C对）。